对结核杆菌有高度选择性的药物是
A. 异烟肼
B. 链霉素
C. 阿米卡星
D. 利福平
E. 庆大霉素

正确答案：A。异烟肼

解析：异烟肼选择性作用于结核杆菌，对其他微生物无效。异烟肼不仅对体外快速生长的、生长缓慢的和间歇缓慢生长的结核杆菌有杀灭作用，而且对细胞内的结核杆菌也具有杀菌作用，故称为全杀菌剂（A对）。